儿童第二次生长突增的高峰是在
A. 胎儿期
B. 婴儿期
C. 幼儿期
D. 学龄前期
E. 青春期

正确答案：E。青春期

解析：本题考查青春期的特点。儿童第二次生长突增的高峰是在青春期（E对ABCD错）。小儿生长发育的高峰期有两个阶段，分别是婴儿时期和青春期，小儿如果处于这两个阶段，建议保证小儿营养充足，并且小儿可以适当运动，从而促进生长发育。